原发性醛固酮增多症引起
A. 盐水反应性碱中毒
B. 盐水抵抗性碱中毒
C. 两者均有
D. 两者均无
E. 无

正确答案：B。盐水抵抗性碱中毒

解析：盐水抵抗性碱中毒是指由于盐皮质激素的直接作用和低k+，给予盐水没有治疗效果，患者患有原发性醛固酮增多症时醛固酮分泌增多，过刺激集合管泌氢细胞的H+-ATP酶（氢泵），促进H+排泌，也可通过保Na+排k +促进H+排泌，而造成低k+，发生盐水抵抗性碱中毒（B对）。